下列各项中，属于四逆汤主治病证临床表现的是
A. 神衰欲寐
B. 脐腹疼痛
C. 心下满痛
D. 泻痢下重
E. 烦躁欲死

正确答案：A。神衰欲寐

解析：四逆汤功效回阳救逆，治疗四肢厥逆，恶寒蜷缩，神衰欲寐（A对），面色苍白，腹痛下利，呕吐不渴的少阴心肾阳衰寒厥证之基础方。